下列辅料中，可作胃溶性包衣材料的是
A. MCC
B. HPMC
C. PEG400
D. CAP
E. CMC-Na

正确答案：B。HPMC

解析：本题考查片剂的包衣。HPMC（羟丙甲纤维素）（B对）是胃溶型薄膜包衣材料；MCC（微晶纤维素）（A错）为稀释剂；PEG400（聚乙二醇400）（C错）为致孔剂；CAP（醋酸纤维素酞酸酯）（D错）为肠溶型薄膜包衣材料；CMC-Na（羧甲基纤维素钠）（E错）为黏合剂或崩解剂。